原发性高血压在高血压中所占比例为
A. 0.7
B. 0.75
C. 0.8
D. 0.85
E. 0.9

正确答案：E。0.9

解析：高血压可分为原发性高血压（即高血压病）和继发性高血压（即症状性高血压）两大类，原发性高血压占高血压的90％以上，继发性高血压指的是某些确定的疾病和原因引起的血压升高，约占高血压不到10％。掌握“原发性高血压”知识点。